在评价社会人群健康状况时，常用的比较敏感的指标是
A. 总死亡率
B. 年龄别死亡率
C. 标准化死亡率
D. 婴儿死亡率
E. 孕产妇死亡率

正确答案：D。婴儿死亡率